在队列（定群）研究中，观察对象是按
A. 已患病者或未患病者来分组
B. 同性别、同年龄组按不同病种来分类
C. 按暴露于某因素分组
D. 按不同家族史来分组
E. 用随机方法分组

正确答案：C。按暴露于某因素分组

解析：本题考查队列研究的概念。队列研究是将人群按是否暴露于某可疑因素（C对ABDE错）及其暴露程度分为不同组，追踪其各组的结局，比较不同组之间结局频率的差异，从而判定暴露因素与结局之间有无因果关联及关联大小的一种观察性研究方法。